肺结核早期诊断最主要的办法是
A. 痰结核菌检查
B. X线检查
C. 结核菌素试验
D. 红细胞沉降率
E. 白细胞计数和分类

正确答案：B。X线检查

解析：肺结核早期诊断最主要的办法是X线检查（B对），胸部X线检查可以发现肺内病变的部位、范围、有无空洞或空洞大小、洞壁厚薄等，大致能估计结核病灶的病理性质，并能早期发现肺结核，以及判断病情发展及治疗效果，有助于决定治疗方案。痰结核菌检查（A错）灵敏度高，常作为结核病诊断的“金标准”，但费时较长，一般为2～8周，故不作为肺结核早期诊断的主要办法。结核菌素试验阳性（C错）广泛应用于检出结核分枝杆菌的感染，而非检出结核病。红细胞沉降率（D错）主要用于风湿热、恶性肿瘤、贫血等的诊断。白细胞计数和分类（E错）主要用于各种炎症性疾病的诊断。